阴道粘膜上皮为
A. 单层高柱状上皮
B. 有纤毛的高柱状上皮
C. 复层鳞状上皮
D. 鳞状上皮化生
E. 生发上皮

正确答案：C。复层鳞状上皮

解析：阴道黏膜上皮为非角化的复层鳞状上皮（C对）。单层高柱状上皮（P7）（A错）为子宫颈管黏膜的被覆上皮。有纤毛的高柱状上皮（P7）（B错）为输卵管的被覆上皮。鳞状上皮化生（P302）（D错）易发生于子宫颈柱状上皮与鳞状上皮交界处。生发上皮（P8）（E错）为卵巢表面的被覆上皮。